上颌体的颞下面参与下列哪一项结构的构成
A. 鼻腔
B. 颞下窝
C. 翼腭窝后壁
D. 翼腭管
E. 鼻腔外侧壁

正确答案：B。颞下窝

解析：上颌骨体后面（颞下面）参与颞下窝和翼腭窝前壁的构成。内面（鼻面）参与鼻腔外侧壁的构成，有上颌窦裂孔、向前下方的沟与蝶骨翼突和腭骨垂直部相接构成翼腭管，管内有腭降动脉和腭神经通过。掌握“上颌骨解剖特点”知识点。